牙龈纤维瘤病涉及最严重的部位是
A. 下颌磨牙颊侧
B. 下颌磨牙舌侧
C. 上颌磨牙颊侧
D. 上颌磨牙腭侧
E. 上颌前牙唇侧

正确答案：D。上颌磨牙腭侧

解析：牙龈纤维瘤病可使牙龈广泛地逐渐增生，可累及全口的牙龈缘、龈乳头和附着龈，甚至达膜龈联合处，以上颌磨牙腭侧最为严重。掌握“牙龈纤维瘤病”知识点。